胞液NADH经苹果酸穿梭机制可得
A. 1.5分子ATP
B. 2.5分子ATP
C. 2分子ATP
D. 3分子ATP
E. 5分子ATP

正确答案：B。2.5分子ATP